某患者右下456左下456牙列缺损，余留牙健康。可摘局部义齿的支点线可以设计成
A. 斜线式
B. 直线式
C. 横线式
D. 纵线式
E. 平面式

正确答案：E。平面式

解析：双侧下颌456非游离缺失，余留牙健康，支点线可设计成平面式。掌握“局部义齿固位体”知识点。